不会影响怀孕的子宫疾病
A. 子宫浆膜下肌瘤
B. 子宫纵隔
C. 子宫肌层肌瘤
D. 子宫息肉
E. 结核性子宫内膜炎

正确答案：A。子宫浆膜下肌瘤

解析：女性不孕因素中盆腔因素约占不孕不育症病因的35%，包括子宫纵隔（B错）、子宫肌层肌瘤（C错）、子宫息肉（D错）和结核性子宫内膜炎（E错），不包括子宫浆膜下肌瘤。